（）中毒可引起紫绀
A. 苯胺
B. 一氧化碳
C. 氰化氢
D. 氯气

正确答案：A。苯胺

解析：本题考查中毒可引起紫绀的物质。苯胺（A对BCD错）可经呼吸道、皮肤和消化道进入人体，如果短期内皮肤吸收或者通过呼吸道吸入大量苯胺，可发生急性中毒，主要表现为紫绀，舌唇、指甲、面颊、耳廓呈蓝褐色，严重时皮肤粘膜呈青灰色，并有头晕，头痛，乏力，胸闷，心悸，气急，食欲不振，恶心，呕吐。严重者可出现意识障碍。